生用兼发表，醋制能增强止痛作用的药是
A. 青皮
B. 香附
C. 川楝子
D. 青木香
E. 延胡索

正确答案：E。延胡索

解析：本题考查的是延胡索的与性能特点用法用量。生用兼发表，醋制能增强止痛作用的药是延胡索（E对）。延胡索：【性能特点】本品辛散苦泄温通，入心、肝、脾经。活血行气，止痛力强。疼痛属血瘀气滞者皆可投用，以兼寒者为佳。【用法用量】内服：煎汤，3～10g；研末，每次1.5～3g。醋制可增强止痛作用。青皮（A错）：【性能特点】本品苦降下行，辛温行散，药力颇强，入肝、胆、胃经。既善疏肝破气，治肝郁胁痛、乳房疾患、寒疝腹痛；又善散结消滞，治癥瘕积聚、久疟癖块及食积腹痛。【用法用量】内服：煎汤，3～10g；或入丸散。醋制疏肝止痛力强。香附（B错）：【性能特点】本品辛香行散，微苦略降，微甘能和，平而不偏。入肝、三焦经。善疏肝理气而止痛，为疏肝理气之佳品，被李时珍誉为“气病之总司，女科之主帅”。肝气舒畅，气血和顺，则月经自调，疼痛可除，故又为调经止痛之要药。【用法用量】内服：煎汤，6～10g；或入丸散。外用：适量，研末撒、调敷或做饼热熨用。醋制止痛力增强。川楝子（C错）：【性能特点】本品苦泄寒清，有小毒，力较强。入肝、胃、小肠、膀胱经。既疏肝泄热、行气止痛，治肝郁气滞或肝胃不和诸痛，兼热者最宜。以毒攻毒，内服能杀虫，外用能疗癣。【用法用量】内服：煎汤，3～10g；或入丸散。外用：适量，研末调涂。青木香（D错）：【性能特点】本品辛香行散，苦寒清泄，有小毒，力较强。入肝、胃经，能调理肝胃气机而行气止痛，治肝胃气痛有热、脘腹胀痛、痧胀或泻痢腹痛。以毒攻毒，解毒消肿，治蛇虫咬伤、痈肿疔毒及湿疮痒痛。【注意】因青木香可引起肾脏损害，原国家食品药品监督管理局于2004年发布通知，取消青木香的药用标准，凡国家药品标准处方中含有青木香的中成药品种应将处方中的青木香替换为《中国药典》收载的土木香（仅限于以菊科植物土木香的干燥根替换）。